正确描述左心室的是
A. 有梳状肌
B. 有卵圆窝
C. 出口为肺动脉口
D. 入口周缘附有左房室瓣
E. 通常有三个乳头肌

正确答案：D。入口周缘附有左房室瓣

解析：左心室入口即左房室口周缘附有左房室瓣（D对）即二尖瓣。